接触苯的氨基硝基化合物引起溶血性贫血的作用机制中，与下列哪项因素有关
A. 高铁血红蛋白形成
B. 还原型谷胱甘肽的减少
C. 氧化型谷胱甘肽的减少
D. 赫恩小体的形成
E. 还原型谷胱甘肽的减少及赫恩小体的形成

正确答案：E。还原型谷胱甘肽的减少及赫恩小体的形成